关于粉体性质的说法，错误的是
A. 休止角小的粉体流动性好
B. 孔隙率大的粉体可压性差
C. 孔隙率小的粉体堆密度大
D. 轻质粉体堆密度大
E. 含水量小的粉体流动性较好

正确答案：D。轻质粉体堆密度大

解析：本题考查粉体的性质。关于粉体性质的说法，错误的是轻质粉体堆密度大（D错，为本题正确答案）。休止角与细粉的百分比有关，如百分比大，休止角亦大。片剂颗粒中加入滑石粉，并以加入量对休止角作图，可以看到休止角出现一临界点，即在此百分比时有最小的休止角，即有最好的流动性，即休止角小的粉体流动性好（A对）。孔隙率：粉体中的孔隙包括微粒本身的孔隙和微粒间的空隙。其孔隙率系指微粒中孔隙和微粒间的空隙所占的容积与粉体容积之比。通常粗大、粒度分布不均匀的粒子，会导致颗粒充填不均匀，片重差异大，而且使压片机的冲头压力分布不均，片剂硬度差，容易产生裂片。空隙率大的粉体可压性差（B对）。堆密度：系指粉体质量除以粉体所占容器的容积求得的密度，该容积是指包括微粒本身的孔隙以及微粒间的空隙在内的总容积。凡堆密度小，亦即堆容积（包括微粒内孔隙及微粒间空隙）大的属于“轻质”；“重质”则是粉体堆密度大，而堆容积小。孔隙率小的粉体堆密度大（C对）。粉体的流动性与粒子间的作用力（如范德华力、静电力等）、粒度、粒度分布、粒子形态及表面摩擦力等因素有关。粉体流动性的表示方法较多，一般用休止角和流速等表示。粉体中的水分含量对休止角有影响，在一定范围内休止角因水分含量的增加而变大。但当超过某一限度（12%）时，则又逐渐变小。一般认为是由于粉体的孔隙被水分子所充满，以及含水量达到一定限度后水可起润滑作用的综合原因所造成。含水量小的粉体流动性较好（E对）。